能减弱心肌收缩力延长APD和ERP的药物是
A. 利多卡因
B. 奎尼丁
C. 美西律
D. 妥卡尼
E. 苯妥英钠

正确答案：B。奎尼丁